饮食变化大，由乳类向成人饮食过渡是哪一发展阶段
A. 婴儿期
B. 胎儿期
C. 围产期
D. 幼儿期
E. 新生儿期

正确答案：D。幼儿期

解析：幼儿期，饮食变化大，由乳类向成人饮食过渡。掌握“小儿年龄分期”知识点。